疲劳的确切定义是
A. 正常的心理反应
B. 作业能力急剧下降
C. 早期病理变化
D. 体力和脑力工作效率暂时的降低
E. 体力和脑力工作效率持久的降低

正确答案：D。体力和脑力工作效率暂时的降低